子宫脱垂的治疗原则是
A. 虚者补之，陷者举之，脱者固之
B. 寒则温之
C. 实则泻之
D. 热则清之
E. 调整阴阳

正确答案：A。虚者补之，陷者举之，脱者固之

解析：子宫脱垂是指子宫从正常位置沿阴道下降，宫颈外口达坐骨棘水平以下，甚至子宫全部脱出于阴道口外，多由身体虚弱，正气不足，气虚失于收摄所致。依据临床症状与表现可分为：1、中气下陷证，治疗原则为补益中气，升阳举陷，即“虚者补之，陷者举之”2、肾气亏虚证，治疗原则为补肾固脱，升阳举陷，即“脱者固之”；3、湿热型，治疗原则为清热利湿（A对）。